处方审核结果分类合理用药和不合理用药，下列情形应判定为不合理用药的是
A. 无适应证用药
B. 无正当理由开具高价药
C. 无正常理由超说明书药
D. 使用药品通用名开具处方
E. 无正当理由为同一患者同时开具两种以上药理作用机制相同的药物

正确答案：A、B、C、E。无适应证用药；无正当理由开具高价药；无正常理由超说明书药；无正当理由为同一患者同时开具两种以上药理作用机制相同的药物

解析：本题考查不合理用药。处方审核结果分为合理用药和不合理用药，不合理处方包括不规范处方、用药不适宜处方及超常处方。无适应证用药（A对）、无正当理由开具高价药（B对）、无正常理由超说明书用药（C对）、无正当理由为同一患者同时开具两种以上药理作用机制相同的药物（E对），应当判定为超常处方。使用药品通用名开具处方（D错）属于合理用药。